关于空气净化的表述，不正确的是
A. 为了避免各室间的相互污染，洁净室应保持负压
B. 洁净室空气洁净度的划分以100级为最高，300000级为最低
C. 空气滤过器按效率可分为初效滤过器、中效滤过器和高效滤过器
D. 气流以平行线的方式流动，称为层流
E. 气流具有不规则的运动轨迹，称为乱流

正确答案：A。为了避免各室间的相互污染，洁净室应保持负压